医学模式的特点不包括
A. 广泛性
B. 普遍性
C. 社会性
D. 波动性
E. 渐进性

正确答案：D。波动性

解析：本题考查医学模式的特点。医学模式的特点包括：1.社会性（C对）：与社会的发展息息相关；2.普遍性（B对）：任何人都受其影响（健康观、疾病观等）；3.广泛性（A对）：影响无所不在；4.渐进性（E对）：表现为动态地发展，与社会、经济、文化、政治、科学等的发展密切相关；5.稳定性：稳定与发展并存。波动性（D错，为本题正确答案）不是医学模式的特点。